刺激胰岛素分泌的最主要的因素是
A. 迷走神经兴奋
B. 促胃液素释放
C. 胰高血糖素释放
D. 血糖浓度增高
E. 血糖浓度降低

正确答案：D。血糖浓度增高

解析：血中葡萄糖水平是调节胰岛素分泌最重要的因素，血糖浓度增高（D对）时，刺激胰岛素分泌。迷走神经兴奋（A错）释放乙酰胆碱，可直接作用于β细胞膜中的M受体，刺激胰岛素分泌，也可通过引起胃肠激素分泌增多而间接促进胰岛素分泌，但不是刺激胰岛素分泌的最主要的因素。促胃液素释放（B错）引起胃肠激素分泌增多而间接促进胰岛素分泌，也不是刺激胰岛素分泌的最主要的因素。胰高血糖素（C错）释放可通过直接作用于β细胞及升高血糖间接促进胰岛素的分泌，也不是刺激胰岛素分泌的最主要的因素。血糖浓度降低（E错）抑制胰岛素分泌。